以上牙周膜纤维中符合牙槽嵴组纤维的特点的是
A. 牙周膜中数量最多、力量最强的一组纤维
B. 呈放射状止于根尖周围的牙槽骨
C. 是维持牙齿直立的主要力量，防止牙齿侧方移动
D. 可以防止牙齿根部向冠方移动的作用
E. 主要分布在牙齿的颊舌侧，邻面无此纤维

正确答案：E。主要分布在牙齿的颊舌侧，邻面无此纤维

解析：本题考查牙周膜。牙槽嵴组：纤维起自牙槽嵴顶，呈放射状向牙冠方向走行，止于牙颈部的牙骨质。此纤维存在于颊舌侧，在邻面无此纤维（E对）。